协助呼气的肌肉是
A. 肋间内肌
B. 肋间外肌
C. 胸大肌
D. 胸小肌
E. 前锯肌

正确答案：A。肋间内肌

解析：肋间内肌（A对）降肋助呼气，即是协助呼气的肌肉。肋间外肌（B错）提肋助吸气。胸大肌（C错）使肩关节内收、旋内和前屈。胸小肌（D错）拉肩胛骨向前下方。前锯肌（E错）拉肩胛骨向前并紧贴胸廓。